下列属于对放射不敏感的肿瘤是
A. 基底细胞癌
B. 未分化癌
C. 浆细胞肉瘤
D. 恶性淋巴瘤
E. 恶性黑色素瘤

正确答案：E。恶性黑色素瘤

解析：对放射不敏感的肿瘤：应以手术治疗为主，手术前后可给以化学药物作为辅助治疗，这类肿瘤如骨肉瘤、纤维肉瘤、恶性黑色素瘤等。掌握“口腔颌面部肿瘤的治疗原则及预防”知识点。